支气管哮喘急性发作早期的动脉血气特征是
A. 代谢性酸中毒
B. 呼吸性碱中毒
C. 代谢性碱中毒
D. 呼吸性酸中毒
E. 混合性酸碱失衡

正确答案：B。呼吸性碱中毒

解析：支气管哮喘发作早期因过度通气CO₂排出过多，表现为呼吸性碱中毒（B对）。病情发展恶化后，CO₂出现潴留就会引起呼吸性酸中毒（D错）。因体内酸碱调节慢于呼吸性变化引起的酸碱失衡，所以代谢性的酸碱平衡多不在早期表现（ACE错）。